诊断癫痫通常主要依靠
A. 脑电图检查
B. 神经系统体检
C. 脑CT
D. 临床表现
E. 脑脊液检查

正确答案：D。临床表现

解析：癫痫的诊断、分型和鉴别诊断都主要依靠临床表现（D对）。常规头皮脑电图检查（A错）仅能记录到49.5%患者的痫性放电。癫痫发作的间歇期神经系统检查（B错）常为阴性。脑CT（C错）只能用于发现存在脑结构异常或病变的癫痫。脑脊液检查（E错）对癫痫诊断价值不大。